下列哪项不属于意识障碍
A. 嗜睡
B. 抽搐
C. 意识模糊
D. 谵妄
E. 昏迷

正确答案：B。抽搐

解析：意识障碍是指人对周围环境及自身状态的识别和觉察能力出现障碍，可表现为嗜睡（A对）、意识模糊（C对）、昏睡和谵妄（D对），严重的意识障碍为昏迷（E对）。抽搐是指全身或局部成群骨骼肌非自主的抽动或强烈收缩，常可引起关节运动和强直，属于不随意运动（B错，为本题正确答案）。